治疗心律失常气阴两虚证宜补气养心，滋阴安神，首选
A. 十味温胆汤
B. 桃仁红花煎
C. 导痰汤
D. 炙甘草汤
E. 黄连阿胶汤

正确答案：D。炙甘草汤

解析：患者心气阴两虚，心失濡养，故见心悸；宗气衰少，功能减退，故见气短，乏力；虚热扰心，神不守舍，故见失眠多梦；阴不制阳，虚热内生，故见自汗盗汗，五心烦热；气血不足，血脉不荣，故见舌质淡红少津，脉虚弱或结代。治疗心律失常气阴两虚证宜补气养心，滋阴安神，方药：炙甘草汤（D对）。十味温胆汤益气养血，化痰宁心，治疗心虚胆怯，痰浊内扰证（A错）。桃仁红花煎活血化瘀，理气通络，治疗心律失常心脉瘀阻证（B错）。导痰汤燥湿豁痰，行气开郁，治疗痰涎壅盛，胸膈痞塞（C错）。黄连阿胶汤扶阴散热，治疗少阴病，心中烦，不得卧；邪火内攻，热伤阴血，下利脓血（E错）。